为自身免疫性疾病，上皮细胞间的桥粒蛋白为抗原物质的是以下哪种疾病
A. 天疱疮
B. 良性黏膜类天疱疮
C. 扁平苔藓
D. 白斑
E. 红斑

正确答案：A。天疱疮

解析：天疱疮为自身上皮棘层细胞间的桥粒蛋白（属于细胞之间的粘连蛋白）为本病的抗原。掌握“口腔黏膜下纤维化与天疱疮，类天疱疮”知识点。